职业中毒诊断的主要依据是
A. 临床症状与体征
B. 实验室检查及症状与体征
C. 职业史、实验室检查及劳动卫生现场调查
D. 接触有毒物质的种类、浓度及时间
E. 病人的工种、工龄及现场劳动条件

正确答案：C。职业史、实验室检查及劳动卫生现场调查

解析：本题考查职业中毒的诊断依据。职业中毒的诊断依据主要为以下几项：1.职业史，是职业中毒诊断的重要前提；2.职业卫生现场调查，是诊断职业中毒的重要参考依据；3.症状与体征；4.实验室检查（C对ABDE错），对职业中毒的诊断具有重要意义，主要包括接触指标和效应指标。